城市环境噪声的评价指标不包括
A. 等效连续A声级
B. 昼间等效声级、夜间等效声级
C. 累计百分声级
D. 最大声级
E. 日平均声级

正确答案：E。日平均声级

解析：本题考查城市环境噪声的评价指标。城市环境噪声的评价指标包括：1.A声级；2.等效连续A声级（A对）；3.昼间等效声级、夜间等效声级（B对）；4.累计百分声级（C对）；5.最大声级（D对）。日平均声级（E错，为本题正确答案）不是城市环境噪声的评价指标。